肝硬化腹水的腹部外形常呈
A. 舟状腹
B. 尖腹
C. 气腹
D. 蛙腹
E. 球状腹

正确答案：D。蛙腹

解析：当腹腔内有大量液体聚集时称为腹水或腹腔积液。常见于肝硬化门静脉高压症，亦可见于心力衰竭、缩窄性心包炎、腹膜转移癌（肝癌、卵巢癌多见）、肾病综合征或结核性腹膜炎等。由于腹水重力的作用，平卧位时腹壁松弛，液体下沉于腹腔两侧，使腹部呈扁而宽状，称为蛙腹（D对）。舟状腹多见于显著消瘦、严重脱水及恶病质等，如慢性消耗性疾病晚期（结核病、败血症等）、恶性肿瘤、糖尿病、神经性厌食、垂体前叶功能减退及甲亢的晚期患者。严重者前腹壁极度凹陷，几乎贴近脊柱，常见到腹主动脉搏动，肋弓 、髂嵴和耻骨联合显露，使腹外形呈舟状，称舟状腹（A错）。腹膜因炎症或肿瘤浸润时导致腹肌紧张，常使腹部呈尖凸型，称为尖腹（B错）。积气在腹膜腔内称为气腹，常见于胃肠穿孔或治疗性人工气腹，前者常伴有腹膜炎（C错）。腹内积气多在胃肠道内，称为胃肠胀气。胃肠大量积气可使全腹膨隆，腹部呈球形，两侧腹部膨出不明显，移动体位时腹部形状无明显改变。多见于各种原因引起的机械性肠梗阻或麻痹性肠梗阻（E错）。